男孩，4岁，站立不稳，不会喊“爸妈”，刚会走路，表情呆滞，眼外角上斜，鼻梁低平。身材矮小，四肢短，韧带松弛，四肢关节过度弯曲。该患儿最可能的诊断是
A. 佝偻病
B. 营养不良
C. 斜视
D. 21-三体综合征
E. 脑发育不良

正确答案：D。21-三体综合征